治疗眩晕痰浊中阻证，应首选
A. 天麻钩藤饮
B. 半夏白术天麻汤
C. 镇肝熄风汤
D. 补阳还五汤
E. 地黄饮子

正确答案：B。半夏白术天麻汤

解析：痰湿中阻证之眩晕为痰浊中阻，上蒙清窍，清阳不升所致，治疗应用半夏白术天麻汤化痰祛湿（B对）。天麻钩藤饮平肝潜阳，清火息风，用于肝阳偏亢，风阳上扰所致的眩晕、中风等（A错）。镇肝熄风汤滋阴潜阳，息风通络，用于阴虚风动之中风（C错）。补阳还五汤益气养血，化瘀通络，用于气虚络瘀之中风恢复期（D错）。地黄饮子滋肾阴，补肾阳，开窍化痰，用于下元虚衰，虚火上炎，痰浊上泛所致之舌强不语，足废不用等症（E错）。